根据《中华人民共和国药品管理法》，进口药品检验费收缴办法的制定部门是
A. 国务院药品监督管理部门
B. 国务院药品监督管理部门会同海关总署
C. 国务院财政部门会同国务院价格主管部门
D. 国务院财政部门会同国务院药品监督管理部门
E. 国务院工商行政管理部门

正确答案：D。国务院财政部门会同国务院药品监督管理部门

解析：本题考查药品监督管理。根据《中华人民共和国药品管理法》，进口药品检验费收缴办法的制定部门是国务院财政部门会同国务院药品监督管理部门（D对）。《中华人民共和国药品管理法实施条例》第八章药品监督第五十七条依据《药品管理法》和本条例的规定核发证书、进行药品注册、药品认证和实施药品审批检验及其强制性检验，可以收取费用。具体收费标准由国务院财政部门、国务院价格主管部门制定。